关于妊娠期拔牙的注意事项哪项是错误的
A. 妊娠期前3个月不宜拔牙，否则易流产
B. 妊娠6个月以后拔牙较好
C. 妊娠4～6个月时拔牙较为合适
D. 不用含肾上腺素的局麻药
E. 保证手术无痛，以增加安全性

正确答案：B。妊娠6个月以后拔牙较好

解析：本题考查系统疾病对牙拔除术的影响及拔牙禁忌证-妊娠。关于妊娠期拔牙的注意事项错误的是妊娠6个月以后拔牙较好（B错，为本题的正确答案）。妊娠4～6个月时拔牙较为合适（C对），对母体和胎儿都比较安全；妊娠期前3个月（A对）易发生流产，此时母体可能仍有恶心、呕吐等反应，使口腔内的操作困难；妊娠6个月以后拔牙有可能早产，故此期间不宜拔牙。肾上腺素（D对）可引起患者紧张、恐慌，而孕妇拔牙时更需要镇静，因此麻药中不应加肾上腺素。手术无痛，可缓解患者的恐惧以增加安全性（E对）。